小婴儿化脓性脑膜炎怀疑合并硬膜下积液，首选的简便诊断方法是
A. 颅脑B超检查
B. 颅脑MRI检查
C. 颅透光检查
D. 试验性硬膜下穿刺
E. 腰穿脑脊液检查

正确答案：C。颅透光检查

解析：硬脑膜下积液（第七版诸福棠实用儿科学P916）有时积液量不多，颅透光试验却可以较早的检测出来，因此颅透光检查（C对）简便、无创，应为小婴儿化脓性脑膜炎怀疑合并硬膜下积液的首选诊断方法。颅透光检查呈阴性但仍疑有硬脑膜下积水的患儿可做颅脑B超检查（A错）和颅脑CT检查。颅脑MRI检查（B错）由于对硬脑膜下积液诊断的作用与效果和CT、B超类似，且价格昂贵，故不做首选。试验性硬膜下穿刺（D错）、腰穿脑脊液检查（E错）是用来确诊化脓性脑膜炎的有创检查，并非首选检查。